关于楔束的描述,正确的是
A. 脊髓全长的后索均有
B. 传导下肢的深部感觉和精细触觉
C. 楔束纤维上行至同侧楔束核内交换神经元
D. 一侧脊髓损伤将出现对侧深部感觉障碍
E. 无上述情况

正确答案：C。楔束纤维上行至同侧楔束核内交换神经元

解析：楔束起自同侧第4胸节及以上的脊神经节细胞，位于后索的外侧部（A错）。楔束传导同侧躯干及上下肢的肌、腿、关节的本体感觉（位置觉、运动觉和震动觉）和皮肤的精细触觉信息（B错），在同侧楔束核内交换神经元（C对）。